在水中能与氯形成氯化消毒副产物的有机物称为
A. 有机前体物
B. 三卤甲烷
C. 卤代乙酸
D. 藻毒素
E. 氯化羟基呋喃酮

正确答案：A。有机前体物

解析：本题考查有机前体物。在水中能与氯形成氯化消毒副产物的有机物称为有机前体物（A对BCDE错），如腐殖酸、富里酸、藻类及其代谢物、蛋白质等。